患者左眼裂狭小，左瞳孔较右侧小，对光反射灵敏，左眼球内陷，面部无汗，其病征为
A. Horner征
B. 动眼神经不全麻痹
C. 面肌痉挛
D. 面神经麻痹
E. 重症肌无力

正确答案：A。Horner征

解析：患者左眼裂狭小，左瞳孔较右侧小，对光反射灵敏，左眼球内陷，面部无汗，其病征为Horner征（A对），动眼神经不全麻痹（B错）瞳孔是扩大的。面肌痉挛（C错）亦称为面肌抽搐，是指一侧面部肌肉间断性不自主阵挛性抽动或无痛性强直。面神经麻痹（D错）主要表现为患侧面部表情肌瘫痪，额纹消失，不能皱额蹙眉，眼裂不能闭合或者闭合不全。重症肌无力（E错）临床主要表现为部分或全身骨骼肌无力和极易疲劳，活动后症状加重，经休息和胆碱酯酶抑制剂治疗后症状减轻。